新生儿败血症的早期临床特点是
A. 发热
B. 体重不增
C. 不哭，懒动
D. 食欲减退
E. 缺乏特异性症状

正确答案：E。缺乏特异性症状

解析：新生儿败血症的早期临床特点是症状、体征不典型，缺乏特异性症状（E对）。发热（A错）、体重不增（B错）、不哭，懒动（C错）、食欲减退（D错）等症状均可见于新生儿败血症的早期，但E更具概括性。